下列说法错误的是
A. 心理是脑的功能
B. 脑是心理的器官
C. 心理是对事物的主观反映
D. 客观现实是心理的源泉
E. 心理能客观地反映事物

正确答案：E。心理能客观地反映事物

解析：首先，心理活动是脑的功能（A对）。人类的心理现象是人脑进化的结果，脑是心理产生的器官（B对），是一切心理活动的物质基础。但是，大脑本身并不能凭空产生心理活动，客观现实是心理的源泉和内容（D对），没有客观现实就没有心理。并且，脑对客观现实进行反映时，不是机械的、被动的反映，是一种主观的反映（C对），受到个人经验、个性特征和自我意识等多种因素的影响。所以，心理的实质是人脑对客观现实的主观能动反映（E错，为本题正确答案）。